可增加胆汁分泌，松弛0ddi括约肌，促胆石溶解和胆汁排出的药物是
A. 葡醛内酯
B. 还原型谷胱甘肽
C. 多烯磷脂酰胆碱
D. 甘草酸二铵
E. 熊去氧胆酸

正确答案：E。熊去氧胆酸

解析：本题考查熊去氧胆酸。可增加胆汁分泌，松弛0ddi括约肌，促胆石溶解和胆汁排出的药物是熊去氧胆酸（E对）；葡醛内酯（A错）进入机体后可与含有羟基或羧基的毒物结合，形成低毒或无毒结合物由尿排出，有保护肝脏及解毒作用；还原型谷胱甘肽（B错）与体内过氧化物和自由基结合，保护细胞中含巯基的蛋白质和酶，参与多种有毒物质解毒反应；多烯磷脂酰胆碱（C错）在乙醇、脂环醇、四氯化碳、扑热息痛和氨基牛乳糖等诱导的急性肝损伤试验模型中具有肝脏保护作用，可用于以肝细胞膜损害为主的急慢性肝炎患者；甘草酸二铵（D错）在化学结构上与醛固酮的类固醇环相似，可阻碍可的松与醛固酮的灭活，从而发挥类固醇样作用，但无皮质激素的不良反应。